由逍遥散化栽为黑逍遥散属于
A. 药味加减的变化
B. 药量增减的变化
C. 剂型更换的变化
D. 药味加减与药量增减变化的联合运用
E. 药味加减与剂型更换变化的联合运用

正确答案：A。药味加减的变化

解析：逍遥散的药物组成为甘草、当归、茯苓、芍药、白术、柴胡、生姜、薄荷，治以疏肝解郁，养血健脾；黑逍遥散即逍遥散加生地或熟地，治以疏肝健脾，养血调经，故二者之间属于药味加减的变化（A对）。